男性40岁，不规则发热半年余，反复抗菌无效，明显消瘦，侨居国外多年，临床考虑是否同艾滋病有关，下列哪项检查既便捷又具特异性
A. 痰培养
B. 胸部CT
C. 血清抗－HIV
D. HIV分离
E. CD4/CD8比值，CD4计数

正确答案：C。血清抗－HIV

解析：排除艾滋病检查既便捷又具特异性的是血清抗－HIV，也是HIV感染诊断的金标准（C对）。